全口义齿组织面内需要缓冲处理的是
A. 腭小凹
B. 翼上颌切迹
C. 下颌舌骨嵴
D. 远中颊角区
E. 磨牙后垫

正确答案：C。下颌舌骨嵴

解析：本题考查无牙颌的功能分区-缓冲区。全口义齿组织面内需要缓冲处理的是下颌舌骨嵴（C对）。下颌舌骨嵴表面覆盖的黏膜较薄，不能承受咀嚼压力，覆盖此区的基托组织面应做适当的缓冲处理。腭小凹位于上颌后堤区内，与翼上颌切迹、远中颊角区及下颌磨牙后垫，均属于全口义齿的边缘封闭区（ABDE错）。无牙颌的功能分区：1.主承托区：指垂直于（牙合）力方向的区域。包括牙槽嵴顶、腭穹窿的水平区、颊棚区等。2.副承托区：指与（牙合）力方向成角度的区域。包括上下颌牙槽嵴的唇、颊和舌腭侧斜面（不包括硬区），与主承托区之间无明显界限。3.边缘封闭区：是义齿边缘接触的软组织部分，如黏膜皱襞、系带附着部和下颌磨牙后垫。4.缓冲区 指需要缓冲咀嚼压力的区域。包括上颌隆突、颧突、上颌结节的颊侧、切牙乳突、下颌隆突、下颌舌骨嵴以及牙槽嵴上的骨尖、骨棱等部位。